下列哪项不符合二期愈合的特点
A. 组织缺损大
B. 创缘不齐
C. 愈合时间长
D. 愈合后形成微痕
E. 伤口感染

正确答案：D。愈合后形成微痕